肺炎杆菌肺炎
A. 咯血颜色鲜红
B. 铁锈色血痰
C. 砖红色胶冻样粘痰
D. 粉红色乳样痰
E. 粉红色浆液性泡沫样痰

正确答案：C。砖红色胶冻样粘痰

解析：砖红色胶冻样痰是一种比较有特征性的痰液，是肺炎克雷伯杆菌感染后的典型特征。肺炎克雷伯菌为革兰阴性杆菌，病变中渗出液黏稠而重，致使叶间隙下坠。细菌具有荚膜，在肺泡内生长繁殖时，引起组织坏死、液化、形成单个或多发性脓肿。病变累及胸膜、心包时，可引起渗出性或脓性积液（C对ABDE错）。